医师在执业活动中违反卫生行政规章制度或者技术操作规范，造成严重后果的责令暂停执业活动，暂停期限为
A. 3个月以上6个月以下
B. 半年至1年
C. 1年以上，1年半以下
D. 半年以上，3年以下
E. 6个月以上，2年以下

正确答案：B。半年至1年

解析：医师在执业活动中违反卫生行政规章制度或者技术操作规范，造成严重后果的责令暂停执业活动，暂停期限为6个月以上1年以下（B对）。